糖皮质激素增加脂皮素可直接抑制下列哪种物质
A. 磷脂酶A₂
B. 前列腺素
C. 白介素
D. 白三烯
E. 血小板活化因子

正确答案：A。磷脂酶A₂